下列不属于缺铁性贫血患者组织缺铁表现的是
A. 口角炎、舌炎
B. 毛发干枯、脱落
C. 匙状甲
D. 心悸、气短
E. 异食癖

正确答案：D。心悸、气短

解析：口角炎、舌炎，毛发干枯、脱落，匙状甲，异食癖（ABCE对）均属于缺铁性贫血患者组织缺铁表现。心悸、气短（D错，为本题正确选项）属于缺铁性贫血患者的贫血表现。